医务人员共同的首要义务和天职是
A. 维护患者的利益和社会公益
B. 维护医务人员和医院的声誉
C. 维护医务人员和医院的经济效益
D. 维护医务人员和医院的自身利益
E. 维护医务人员之间、医院间的和谐

正确答案：A。维护患者的利益和社会公益